关于散剂质量要求的说法的是，正确的是
A. 除另有规定外，儿科用散剂应为极细粉
B. 含有毒性药多剂量包装的内服散剂应附分剂量用具
C. 除另有规定外，含挥发性药物的散剂应密封贮存
D. 除另有规定外，多剂量包装的散剂应检查装量差异
E. 除另有规定外，单剂量包装的散剂应检查最低装量

正确答案：C。除另有规定外，含挥发性药物的散剂应密封贮存

解析：本题考查的是散剂的质量要求。关于散剂质量要求的说法的是，正确的是除另有规定外，含挥发性药物的散剂应密封贮存（C对）。除另有规定外，散剂应密闭贮存，含挥发性药物或易吸潮药物的散剂应密封贮存。生物制品应采用防潮材料包装。供制备散剂的原料药均应粉碎。除另有规定外，内服散剂应为细粉；儿科及局部用散剂应为最细粉（A错）；眼用散剂应为极细粉，且应无菌。多剂量包装的散剂应附分剂量的用具；含有毒性药的内服散剂应单剂量包装（B错）。多剂量包装的散剂，按照《中国药典》最低装量检查法检查（D错），应符合规定。单剂量包装的散剂应检查装量差异（E错）。